以下哪种方法不用去除牙体组织，在牙齿的点隙裂沟涂布一层黏结性树脂，保护牙釉质不受侵蚀，预防龋病发生
A. 预防性树脂充填
B. 非创伤性修复
C. 点隙裂沟封闭
D. 烤瓷熔附金属全冠修复
E. 嵌体预备

正确答案：C。点隙裂沟封闭

解析：窝沟封闭又称点隙裂沟封闭，是指不去除牙体组织，在（牙合）面、颊面或舌面的点隙裂沟涂布一层黏结性树脂，保护牙釉质不受细菌及代谢产物侵蚀，达到预防龋病发生的一种有效防龋方法。掌握“窝沟封闭术”知识点。